排卵发生在
A. 本次月经第一天的14日后
B. 月经周期的正中间
C. 下次月经来潮前14日左右
D. 下次月经来潮前12日左右
E. 本次月经结束后的第14日左右

正确答案：C。下次月经来潮前14日左右

解析：排卵多发生在下次月经来潮前14日左右。掌握“女性生殖系统生理”知识点。